金气不足，反为木气所伤，属于
A. 己所不胜，侮而乘之
B. 己所胜，轻而侮之
C. 制己所胜
D. 侮所不胜
E. 以上都不是

正确答案：B。己所胜，轻而侮之

解析：《内经》把相克关系称为“所胜”“所不胜”关系；“克我”者为我“所不胜”，“我克”者为我“所胜”。金克木，金气不足，根据“其不及，则己所不胜，侮而乘之，己所胜，轻而侮之”金所胜为木，为木气所伤，即为“己所胜，轻而侮之”（B对）。